麻醉药品控释制剂的处方限量是
A. 不超过三日常用量
B. 不超过二日极量
C. 不超过七日常用量
D. 不超过十五日常用量
E. 不超过三十日常用量

正确答案：C。不超过七日常用量